产褥期保健重点不包括以下哪项
A. 注意产妇情绪的变化
B. 推荐孕产妇营养膳食
C. 注射乙肝疫苗
D. 指导母乳喂养
E. 注意卫生

正确答案：C。注射乙肝疫苗

解析：本题考查产褥期的保健重点。注射乙肝疫苗（C错，为本题正确答案）不属于产褥期的保健重点。产褥期的保健重点：（1）正常分娩的产妇至少住院观察24小时，及时发现产后出血。（2）加强对孕产期合并症和并发症的产后病情监测。（3）创造良好的休养环境，加强营养、心理及卫生指导（E对），注意产妇心理健康（A对）。（4）做好婴儿喂养及营养指导（B对），提供母乳喂养的条件，进行母乳喂养知识和技能（D对）、产褥期保健、新生儿保健及产后避孕指导。（5）产妇出院时，进行全面健康评估，对有合并症及并发症者，应当转交产妇住地的医疗保健机构继续实施高危管理。